止嗽定喘囗服液的使用注意事项有
A. 忌食辛辣油腻食物
B. 高血压病患者慎用
C. 青光眼患者慎用
D. 心脏病患者慎用
E. 阴虚久咳者慎用

正确答案：A、B、C、D、E。忌食辛辣油腻食物；高血压病患者慎用；青光眼患者慎用；心脏病患者慎用；阴虚久咳者慎用

解析：本题考查止咳定喘口服液的注意事项。止嗽定喘囗服液的使用注意事项有忌食辛辣油腻食物（A对）、高血压病患者慎用（B对）、青光眼患者慎用（C对）、心脏病患者慎用（D对）、阴虚久咳者慎用（E对）。止嗽定喘口服液【注意事项】孕妇、阴虚久咳者慎用。服药期间，忌食辛辣、油腻食物。因其含麻黄，故青光眼患者、高血压病患者、心脏病患者慎用。